粉体粒子大小的常用表示方式有
A. 定方向径
B. 等价径
C. 体积等价径
D. 筛分径
E. 有效径

正确答案：A、B、C、D、E。定方向径；等价径；体积等价径；筛分径；有效径

解析：本题考查粉体粒子大小的常用表示方式。粉体粒子大小的常用表示方法包括：①定方向径（A对）：即在显微镜下按同一方向测得的粒子径。②等价径（B对）：即粒子的外接圆的直径。③体积等价径（C对）：即与粒子的体积相同球体的直径。④有效径（E对）：即根据沉降公式（Stock′s方程）计算所得的直径，因此又称Stock′s径。⑤筛分径（D对）：即用筛分法测得的直径，一般用粗细筛孔直径的算术或几何平均值来表示。